下列特定穴中，多用于治疗奇经病证的是
A. 原穴
B. 络穴
C. 八脉交会穴
D. 八会穴
E. 荥穴

正确答案：C。八脉交会穴

解析：八脉交会穴是古人在临床实践中总结出的可治疗奇经八脉病证的8个腧穴，这8个腧穴分别与相应的奇经八脉经气相通。在临床上当奇经八脉出现相关的疾病时，可取对应的八脉交会穴（C对）来治疗。原穴（A错）主要用于治疗相关脏腑的疾病；络穴（B错）既可治疗其络脉的病证，又可治疗表里两经的病证；八会穴（D错）虽属于不同经脉，但对于各自所会的脏、腑、气、血、筋、脉、骨、髓相关的病证有特殊的治疗作用，临床上常把其作为治疗这些病证的主要穴位；荥穴（E错）主要治疗相应经脉的热证。